男性，55岁。被重物砸伤致双下肢广泛软组织挫伤，入院查心率108次/分，血压15.0/8.5kPa（113/64mmHg），急行手术清创。此时的最佳输液原则是
A. 使用升压剂
B. 扩容，碱化尿液
C. 输血
D. 输血浆代用品
E. 输葡萄糖

正确答案：B。扩容，碱化尿液

解析：患者被重物砸伤后而造成双下肢广泛软组织挫伤，应警惕患者可能存在发生挤压综合征的风险。对于挤压伤的治疗除了及早解除重物压力、伤肢制动、开放伤口和活动性出血者应止血外，还应饮用碱性饮料。饮用碱性饮料不仅可以利尿，还可以碱化尿液，避免肌红蛋白在肾小管中沉积，若患者不能进食，可静脉点滴，所以对于该患者最佳输液治疗是扩容，碱化尿液（B对）。而使用升压剂（A错）、输血（C错）及输血浆代用品（D错）主要用于发生休克的患者，而该患者血压为113/64mmHg，未发生休克，故应排除。输葡萄糖（E错）主要用于发生低血糖及高血钾的患者，而该患者未有低血糖及高血钾的临床表现，故应排除。（挤压综合征是指人体四肢或躯干等肌肉丰富的部位遭受重物长时间的挤压，在挤压解除后出现身体一系列的病理生理改变。临床上主要表现为：①肢体肿胀②肌红蛋白尿③高血钾症及高血钾为特点的急性肾功能衰竭④酸中毒及氮质血症等症状⑤休克）。